女性，22岁，因右下智齿低位埋伏阻生，要求拔除。行下齿槽神经阻滞麻醉后，关于麻醉范围错误的是
A. 包括下颌骨
B. 包括下颌牙
C. 包括牙周膜
D. 包括黏骨膜
E. 不包括同侧下唇

正确答案：E。不包括同侧下唇

解析：本题考查下牙槽神经阻滞麻醉的麻醉区域。行下齿槽神经阻滞麻醉后，关于麻醉范围错误的是不包括同侧下唇（E错，为本题的正确答案）。下牙槽神经属于下颌神经，是下颌神经分支中最大的，沿途分布在下颌骨、下牙槽，在下颌骨基底部吻合成下牙槽神经丛，由该丛再分出终末支布于下颌牙齿牙髓及牙周膜和牙槽骨。所以下齿槽神经阻滞麻醉的范围包括同侧下颌骨（A对）、下颌牙（B对）、下颌牙周膜（C对）、下颌黏骨膜（D对），也包括同侧的下唇。